用于治疗骨质疏松症的药物是
A. 糖皮质激素
B. 胰岛素
C. 甲状腺素
D. 炔雌醇
E. 螺内酯

正确答案：D。炔雌醇

解析：本题考查炔雌醇。炔雌醇（D对）属于雌激素，有促进骨质致密的作用。可用于治疗骨质疏松。糖皮质激素（A错）可抑制小肠对钙的吸收，促进尿钙的排泄，通过促进破骨细胞介导的骨吸收和抑制成骨细胞介导的骨形成引起骨质疏松。胰岛素（B错）用于降低血糖。甲状腺素（C错）用于维持机体正常生长发育。螺内酯（E错）是利尿剂。